急性胆囊炎，可见
A. 墨菲征（Murphy）阳性
B. 麦氏点压痛
C. 库瓦济埃征（Courvoisier）阳性
D. 库瓦济埃征（Courvoisier）阴性
E. 板状腹

正确答案：A。墨菲征（Murphy）阳性

解析：急性胆囊炎，可见墨菲征（Murphy）阳性（A对），即患者在检查时处于平卧位，医生站在患者右侧，左手拇指放在胆囊部位，即右侧腹直肌外缘与肋弓交接处（第9肋软骨尖），其余四指放在右胸前下方，患者做深呼吸动作，患者如感觉疼痛加剧而突然屏气，即可诊断为墨菲氏征阳性。麦氏点压痛见于急性阑尾炎（B错）。库瓦济埃征（Courvoisier）阳性见于胰腺癌（C错）。板状腹常见于上消化道出血穿孔（E错）。